关于分析性研究的叙述，下列哪项是正确的
A. 分析性研究属于流行病学实验
B. 流行病学的分析性研究包括数学模型和普查
C. 分析性研究属观察法，主要包括病例对照研究和队列研究
D. 病例对照研究和队列研究的研究时间顺序一致

正确答案：C。分析性研究属观察法，主要包括病例对照研究和队列研究

解析：本题考查分析性研究的叙述。分析性研究属于流行病学观察法（A错），流行病学的分析性研究主要包括病例对照研究和队列研究（C对B错），病例对照研究是由果溯因的研究，队列研究是由因及果的研究，两种研究时间顺序不同（D错）。